外形为子弹状，有包膜的RNA病毒是
A. 人乳头瘤病毒
B. 森林脑炎病毒
C. 巨细胞病毒
D. 狂犬病病毒
E. 柯萨奇病毒

正确答案：D。狂犬病病毒